急性、亚慢性、慢性毒性试验分别选择动物年龄为
A. 初成年，性刚成熟，初断乳
B. 初断乳，性刚成熟，初成年
C. 初断乳，初成年，性刚成熟
D. 初成年，初断乳，性刚成熟
E. 性刚成熟，初断乳，初成年

正确答案：A。初成年，性刚成熟，初断乳